不符合门静脉血流受阻后病理生理变化的是
A. 肝性脑病
B. 脾肿大
C. 门静脉高压性胃病
D. 交通支扩张
E. 腹水

正确答案：A。肝性脑病

解析：门静脉血流受阻后，主要发生下列病理生理变化：①脾肿大（B对）门静脉血流受阻后，脾静脉回流阻力增加及门静脉压力逆传到脾，出现淤血性脾肿大。②交通支扩张（D对）由于正常的肝内静脉通路受阻，门静脉又无静脉瓣，门静脉与腔静脉间许多交通支扩张，形成侧支循环以降低门静脉压力。在门静脉高压时，胃壁淤血、水肿，胃粘膜下层的动静脉交通支广泛开放，胃黏膜微循环发生障碍，导致胃黏膜防御屏障的破坏，形成门静脉高压性胃病（C对）。侧支循环建立后不仅可引起消化道出血，还由于门静脉血不经肝脏解毒而流入体循环，引起肝性脑病（A对）。③腹水（E对）门静脉压力升高，使门静脉系统毛细血管床的滤过压增加，同时肝硬化引起的低蛋白血症，血浆胶体渗透压下降及淋巴液生成增加，促使液体从肝表面、肠浆膜面漏入腹腔形成腹水。根据第八版内科学及八版外科学来看，本题无正确答案，但给出的参考答案为A。